癌的转移方式中，下列何者正确
A. 鳞癌发生血行转移出现早
B. 肺泡细胞癌，早期血行淋巴转移
C. 腺癌早期发生淋巴转移，血行转移较晚
D. 未分化癌早期出现血行、淋巴转移
E. 淋巴转移只发生肺癌同侧

正确答案：D。未分化癌早期出现血行、淋巴转移

解析：鳞癌经淋巴道转移最多见（A错）。肺泡细胞癌血行转移就说明肺癌病人已达至晚期（B错）。腺癌富含血管，局部浸润和血行转移较早，易累及胸膜引起胸腔积液（C错）。未分化癌可较早呈现血行转移、淋巴道转移（D对）。